邪热壅肺证的代表方剂是
A. 桂枝汤
B. 桑杏饮
C. 麻杏石甘汤
D. 银翘散
E. 栀子豉汤

正确答案：C。麻杏石甘汤

解析：麻杏石甘汤具有辛凉疏表，清肺平喘的功效，主治邪热壅肺证（C对）。桂枝汤是风寒感冒表虚证的代表方（A错）；桑杏汤是温燥伤肺之轻证的代表方（B错）；银翘散是风热感冒的代表方（D错）；栀子豉汤是热扰胸膈证的代表方（E错）。